推行临床科学合理用血的最主要目的是
A. 减少临床用血量
B. 降低患者医疗费用
C. 保护血液资源
D. 减轻采供血机构压力
E. 避免输血风险

正确答案：C。保护血液资源

解析：目前我国血液供应紧张问题日益突出，全社会积极呼吁无偿献血。临床科学合理用血不但可以减少临床用血量（A错）、降低患者医疗费用（B错）、有效地缓解采供血机构压力（D错），更主要是为了保护血液资源（C对），缓解血液资源紧张状态。临床科学合理用血可以降低输血风险，但是不能完全的避免输血风险（E错）。